使胃蛋白酶原转变成胃蛋白酶的刺激物是
A. Na⁺
B. Cl⁻
C. K⁺
D. HCl
E. 内因子

正确答案：D。HCl